典型大肠杆菌是指哪种细菌
A. 大肠菌群
B. 埃希菌群
C. 柠檬酸菌属
D. 肠杆菌属
E. 乳杆菌属

正确答案：B。埃希菌群